医患之间的契约关系取决于
A. 双方是陌生人
B. 双方是熟人
C. 双方地位有差别
D. 双方都有独立人格
E. 双方构成供求关系

正确答案：D。双方都有独立人格

解析：医患之间是平等关系，即医师尊重病人的医疗权利，一视同仁地提供医疗服务；病人尊重医师的劳动，并密切配合诊治，共同完成维护健康的任务。掌握“医患关系伦理”知识点。